右上56缺失，右上4冠折，伴有牙槽骨凹陷，可选择
A. 种植固定桥
B. 固定-可摘联合桥
C. 半固定桥
D. 单端固定桥
E. 双端固定桥

正确答案：B。固定-可摘联合桥

解析：右上56缺失，右上4冠折，伴有牙槽骨凹陷，可选择固定-可摘联合桥（B对）。固定-可摘联合桥：其支持形式与双端固定桥相同，义齿承受（牙合）力由基牙承担，但不同之处是该型固定桥可自行摘戴。义齿固位依靠固位体的内外冠之间产生的摩擦力或者磁性固位体的吸力等产生固位。双端固定桥对基牙要求较严格，本题为56缺失，且4冠折，一般不使用双端固定桥修复。掌握“固定桥的组成和分类”知识点。